男婴，4个月。冬季出生。近2日经常出现面部、四肢抽动，双眼上翻，每次持续数10秒，1日数次，可自然缓解，发作后玩耍如常。体温正常。母孕期有腿部抽筋病史。就诊过程中，该患儿突然出现吸气困难，口唇青紫。错误的处理是
A. 吸氧
B. 缓慢静注葡萄糖酸钙
C. 静注地西泮
D. 肌注维生素D
E. 保持呼吸道通畅

正确答案：D。肌注维生素D

解析：4月冬季出生患儿，有间断性面部四肢抽动和双眼上翻的症状，且可以自然缓解，发作后玩耍如常，符合维生素D缺乏性手足搐搦症的特点，应诊断为维生素D缺乏性手足搐搦症，此时该患儿突然出现吸气困难，口唇青紫，说明维生素D缺乏性手足搐搦症正在发作，必须给予急救，而肌注维生素D是抢救成功之后的下一步治疗（D错，为本题正确答案）。吸氧（A对）和保持呼吸道通畅（E对）都可以减缓发作时呼吸道痉挛引起的发绀。缓慢静注葡萄糖酸钙可以迅速提高血钙的浓度，缓解症状（B对）。静注地西泮可迅速控制惊厥或喉痉挛（C对）。